瘢痕性类天疱疮在口腔中病损的最常见部位是
A. 牙龈
B. 下唇
C. 软腭
D. 上腭
E. 颊黏膜

正确答案：A。牙龈

解析：本题考查瘢痕性类天疱疮在口腔中病损的最常见部位。瘢痕性类天疱疮的损害可发生于口腔的任何部位，但以牙龈（A对）最为多见，其次为硬腭和颊部。口腔扁平苔藓（OLP）病损大多左右对称，可发生在口腔黏膜的任何部位，但以颊部（E错）最为多见。盘状红斑狼疮（DLE）在口腔中病损的最常见部位是下唇（B错）。疱疹性咽峡炎在口腔中病损的最常见部位是软腭（C错）。坏死性唾液腺化生在口腔中病损的最常见部位是上腭（D错）。